一种筛检乳腺癌的实验，应用于已经病理检查证实的乳腺癌患者400人和未患乳腺癌400人。结果患癌组有100例阳性，未患癌组有50例阳性。则该试验的特异度为
A. 100/400
B. 350/400
C. 100/150
D. 100/300
E. 50/400

正确答案：B。350/400

解析：本题考查特异度的计算。根据题中数据代入公式得出特异度＝TN/（FP＋TN）＝350/400（B对ACDE错）。